可复性牙髓炎不可能出现的转归是
A. 恢复正常
B. 牙髓退变
C. 不可复性牙髓炎
D. 形成不可复性牙髓炎后发生牙髓坏死
E. 牙内吸收

正确答案：E。牙内吸收

解析：本题考查可复性牙髓炎的转归。牙内吸收多发生于乳牙，或受过外伤的牙、再植牙以及做过活髓切断或盖髓术的牙，可复性牙髓炎不会造成牙内吸收（E错，为本题的正确答案）。可复性牙髓炎是牙髓组织血管扩张充血的炎症表现，若正确的处理安抚可恢复（A对），若没有合适的处理，在持续的刺激会造成不可复性牙髓炎（C对），当变为不可复性牙髓炎仍不给予治疗会导致牙髓坏死（D对）。当牙髓组织受到长期慢性刺激出现不同程度和不同类型的退行性变即为牙髓变性，因此可复性牙髓炎可以转归为牙髓变性即牙髓退变（B对）。